既可用于痰湿蒙蔽清窍的神志昏迷，又可用于噤口痢的药物是
A. 麝香
B. 石菖蒲
C. 冰片
D. 苏合香
E. 牛黄

正确答案：B。石菖蒲

解析：石菖蒲应用于痰蒙清窍，神志昏迷，本品辛开苦燥温通，芳香走窜，不但有开窍醒神之功，兼有化湿，豁痰，辟秽之效。擅长治痰湿秽浊之邪蒙蔽清窍所致神志昏乱；噤口痢，指患痢疾而见饮食不进，食入即吐，或呕不能食者。常见于疫毒痢、湿热痢重症。石菖蒲芳香化湿、燥湿，又行胃肠之气（B对）。麝香的应用于痹症神魂；疮疡中毒，瘰疬痰核，咽喉肿痛。（A错）。冰片的应用于闭证神昏；目赤肿痛，候痹口疮；疮疡肿痛，疮溃不敛，水火烫伤。（C错）。苏合香的应用于寒闭神昏；胸腹冷痛，满闷。（D错）。牛黄的应用于热病神昏；小儿惊风，癫痫；口舌生疮，咽喉肿痛，牙痛，痈疽疔毒。（E错）。